风湿性二尖瓣狭窄最典型的体征是
A. 胸骨右缘第二肋间舒张期叹气样杂音
B. 胸骨左缘第二肋间舒张期隆隆样杂音
C. 胸骨左缘第三肋间舒张期叹气样杂音
D. 心尖部收缩期吹风样杂音
E. 心尖部舒张期隆隆样杂音

正确答案：E。心尖部舒张期隆隆样杂音

解析：风湿性二尖瓣狭窄最典型的体征是心尖部舒张期隆隆样杂音（E对）。胸骨右缘第二肋间（主动脉瓣区）舒张期叹气样杂音（A错）、胸骨左缘第三肋间（主动脉瓣第二听诊区）舒张期叹气样杂音（C错）常见于主动脉瓣关闭不全。胸骨左缘第二肋间舒张期隆隆样杂音（B错）见于肺动脉瓣关闭不全。心尖部收缩期吹风样杂音（D错）常见于二尖瓣关闭不全。